下列学校健康教育活动中属于参与式教学方法的是
A. 课堂教学
B. 讲座
C. 同伴教育
D. 给学生观看健康科普宣传片
E. 示教

正确答案：C。同伴教育